女性，36岁。肥胖，面如满月，红润，四肢相对瘦小，腹部及大腿内侧可见宽大的紫色条纹。此患者一般不会出现以下哪种病史
A. 月经少
B. 易感染
C. 有口干，多尿
D. 精神神经障碍
E. 肾绞痛，血尿

正确答案：E。肾绞痛，血尿